下列有关“单剂量配方系统”的叙述正确的是
A. 英文缩写是TDDS
B. 对所分装的散片无法识别
C. 是一种透明的开放性包装
D. 便于药师、护士及患者自行核对
E. 是按患者1日给药的剂量包装的

正确答案：D。便于药师、护士及患者自行核对

解析：本题考查单剂量配方系统。单剂量配方系统又称单元调剂或单剂量配发药品（UDDS）（A错）。UDDS是按一次剂量（E错）借助分包机用铝箔或塑料袋热合后单独包装（C错）。上面标有药名、剂量等（B错），便于药师、护士及患者自己进行核对（D对）。